患者，男性，59岁。约有10年高血压病史，经强心、利尿治疗好转，但近日病情加重，出现心悸，气短，下肢水肿加重。诊断为原发性高血压，慢性心功不全，心肌肥大，最好加用哪种药物继续治疗
A. 卡托普利
B. 硝苯地平
C. 肼屈嗪
D. 哌唑嗪
E. 氨茶碱

正确答案：A。卡托普利